女，50岁。高热，寒战5天，意识模糊1天。既往体健。查体：T39℃，P120次/分，R22次/分，BP80/50mmHg，皮肤散在出血点和瘀斑，双肺未见异常，心率120次/分，律齐，腹软，肝肋下0.5cm，脾肋下及边。检查：Hb100g/L，WBC25.3×10⁹/L，血培养示大肠埃希菌生长，PT18秒（正常对照13秒），INR2.1，血纤维蛋白原定量108g/L。诊断为大肠埃希菌败血症，可能合并DIC。下述检查对确诊DIC意义不大的是
A. 复查血纤维蛋白原定量
B. 复查血小板数
C. 血小板功能
D. APTT
E. FDP测定

正确答案：C。血小板功能

解析：患者中老年女性，高热、寒战5天，意识模糊1天，检查：Hb100g/L，WBC25.3×10⁹/L，血培养示大肠埃希菌生长（严重感染是DIC的常见基础疾病），BP80/50mmHg提示存在感染性休克，皮肤散在出血点和瘀斑（多发出血倾向），PT18秒（正常对照13秒），INR2.1，提示凝血功能障碍，血纤维蛋白原定量108g/L（血浆纤维蛋白含量＜1.5g/L或进行性下降，或＞4g/L提示DIC），患者诊断为大肠埃希菌败血症，可能合并DIC（弥散性血管内凝血），对DIC确诊有意义的检查包括血小板数目（B错）、血浆纤维蛋白原含量（A错）、APTT（活化部分凝血活酶时间）或PT（凝血酶原时间）测定（D错）、FDP（纤维蛋白降解产物）测定（E错）等；而血小板功能（C对）对DIC诊断意义不大。